嚼槟榔者患颊癌的危险性是不嚼槟榔者的
A. 3倍
B. 4倍
C. 5倍
D. 6倍
E. 7倍

正确答案：E。7倍

解析：咀嚼槟榔：槟榔嚼物一般由槟榔果、老花藤和煅石灰组成，有些地区在其中加烤烟及香料等。嚼槟榔会导致口腔黏膜下纤维性变和白斑的发生，并可转化为口腔癌。口腔癌发生与嚼槟榔时间、槟榔在口腔的滞留时间呈正相关，最常发生的部位是颊部，嚼槟榔者患颊癌的危险性是不嚼槟榔者的7倍。掌握“口腔癌的预防”知识点。